阿米洛利所致的主要不良反应
A. 血尿酸升高
B. 支气管痉挛
C. 血钠升高
D. 外周血肿
E. 血钾升高

正确答案：E。血钾升高

解析：本题考查降压药的不良反应。阿米洛利所致的主要不良反应是血钾升高（E对）。阿米洛利单独使用，高钾血症较为常见。偶尔引起低钠血症，高钙血症，轻度代谢性酸中毒，胃肠道反应。血尿酸升高（A错）是噻嗪类利尿药的不良反应。支气管痉挛（B错）是β受体阻断剂的不良反应。